α-MSH的解热作用是通过
A. 增强散热
B. 减少产热
C. 两者均有
D. 两者均无
E. 无

正确答案：A。增强散热

解析：黑素细胞刺激素（α-MSH）是由腺垂体分泌的多肤激素，由13个氨基酸组成。在使用α-MSH解热时，兔耳皮肤温度增高，说明散热加强（兔主要依靠调整耳壳皮肤血流量来控制散热），因此α-MSH的解热作用是通过增强散热（A对）。